水溶性最强的生物碱是
A. 氧化苦参碱
B. 苦参碱
C. 去氢苦参碱
D. 安那吉碱
E. 巴普叶碱

正确答案：A。氧化苦参碱

解析：本题考查的是苦参碱的溶解性。水溶性最强的生物碱是氧化苦参碱（A对）。苦参碱既可溶于水，又能溶于三氯甲烷、乙醚、苯、二硫化碳等亲脂性溶剂。氧化苦参碱是苦参碱的氮氧化物，具半极性配位键，其亲水性比苦参碱更强，易溶于水，可溶于三氯甲烷，但难溶于乙醚。可利用两者溶解性的差异将其分离。苦参生物碱的极性大小顺序是：氧化苦参碱>羟基苦参碱>苦参碱（B错）。苦参所含生物碱主要是苦参碱和氧化苦参碱，此外还含有羟基苦参碱、N-甲基金雀花碱、安那吉碱（D错）、巴普叶碱（E错）和去氢苦参碱（C错）等。